研究对象不知道自己在实验组还是对照组的是
A. 非盲试验
B. 双盲
C. 三盲
D. 单盲
E. 开放性试验

正确答案：D。单盲

解析：本题考查实验流行病学盲法的应用。研究对象不知道自己在实验组还是对照组的是单盲（D对ABCE错）。